有头疽初起症状多见
A. 粟粒样脓头
B. 蜂窝样脓头
C. 肿块坚硬如钉丁之状
D. 漫肿无头
E. 腐烂疮面

正确答案：A。粟粒样脓头

解析：有头疽多发于项背部肌肉丰厚处。初起有一粟粒样脓头（A对），焮热红肿胀痛，迅速向深部或周围扩散，脓头相继增多，溃脓后疮面腐烂（E错），状如莲蓬、蜂窝（B错），范围常超过9～12cm，大者可在30cm以上；疔的特点是疮形虽小，但根脚坚硬，有如钉丁状（C错）；无头疽初起无头，发无定处，病位较深，漫肿（D错）疼痛彻骨，难消，难溃，难敛。